B级）患者的推荐起始剂量为每次50mg，每天两次。在患者能够耐受的情况下，可以每2～4周倍增一次本品剂量，直至达到目标维持剂量每次200mg，每天两次。不可与沙库巴曲缬沙坦合用的药物是
A. 比索洛尔
B. 螺内酯
C. 呋塞米
D. 贝那普利
E. 氨氯地平

正确答案：D。贝那普利

解析：本题考查沙库巴曲缬沙坦。用法用量中指出：沙库巴曲缬沙坦与ACEI合用时存在血管性水肿的潜在风险，因此不可与沙库巴曲缬沙坦合用的药物是贝那普利（D对），其为ACEI类药物。